健康危险度评价的主要特点是
A. 以可接受的危险程度代替安全性
B. 其评价方法可以在更大的程度上保证健康
C. 把环境污染对人体健康的影响定量化
D. A＋C
E. A＋B

正确答案：D。A＋C

解析：本题考查健康危险度评价的特点。健康危险度评价的主要特点是：①健康保护观念的转变。安全是相对的，在任何情况下要绝对的安全是不可能的。因为不可能将有害健康的污染物完全清除，只能逐步控制污染，使对健康的影响处于一般人可接受的危险水平。②把环境污染对人体健康的影响定量化（D对ABCE错）。环境污染对人体健康的影响或危害不仅是“有”或“无”、“是”或“否”的判别标准，而是定量地阐明危害健康的程度。